一侧肾内结石长径3.5cm伴肾积水，首要的治疗方法
A. 经皮肾镜碎石取石术
B. 输尿管镜取石术
C. 体外冲击波碎石
D. 肾实质切开取石术
E. 输尿管切开取石术

正确答案：A。经皮肾镜碎石取石术

解析：泌尿系结石治疗总结：1.药物治疗，肾、输尿管结石≤0.6cm；2.体外冲击波碎石ESWL（C错），肾结石、输尿管上段结石≤2cm；3.输尿管镜取石URL（B错），输尿管中下段≤2cm；4.经皮肾镜碎石取术PCNL（A对），肾结石>2cm（本例肾结石3.5cm）；4.腹腔镜输尿管取石LUL（E错），输尿管结石>2cm。肾实质切开取石术（D错）属于开放手术治疗，由于ESWL及内镜技术的普遍开展，目前上尿路结石大多数已不再用开放手术。轻度肾积水一般不影响手术，重度肾积水必须先造瘘，伴尿路感染者先抗感染。